女，28岁。妊娠42周，OCT试验阳性，羊水深度3.0cm，胎头双顶径10cm。此时最恰当的处理是
A. 剖宫产终止妊娠
B. 前列腺素促宫颈成熟
C. 宫颈评分
D. 人工破膜引产
E. 缩宫素引产

正确答案：A。剖宫产终止妊娠

解析：患者女，28岁。妊娠42周，OCT试验阳性，诊断为过期妊娠。羊水深度3.0cm，胎头双顶径10cm（＞9.5cm）为剖宫产指证。最恰当的处理是剖宫产终止妊娠（A对）。